暑邪伤人，常见胸闷，四肢困倦等症，是由于
A. 暑为阳邪，其性炎热
B. 暑伤脾胃，纳食减少
C. 暑多挟湿，阻遏气机
D. 暑性升散，伤津耗气
E. 暑性开泄，易袭阳位

正确答案：C。暑多挟湿，阻遏气机

解析：暑季气候炎热，且常多雨而潮湿，热蒸湿动，水气弥漫，故暑邪致病，多挟湿邪为患，常见四肢困倦的症状又因湿邪阻遏气机的特点，湿阻胸膈所以胸闷（C对）。暑为阳邪，其性炎热，暑邪伤人多表现为一系列阳热症状，如，高热、心烦、面赤、脉洪大等（A错）。暑伤脾胃，可致纳食减少（B错）。暑性升散，扰神伤津耗气：“升”，即升发，向上。暑为阳邪，其性升发，故易上扰心神，或侵犯头目，出血心胸烦闷不宁、头昏、目眩、面赤等。“散”，指暑邪侵犯人体，可致腠理开泄而多汗（D错）。暑性开泄而多汗，易袭阳位，可致气虚阳气不足（E错）。